患儿，男，2周岁，因普通感冒引起高热，哭闹不止，医师处方给予布洛芬口服混悬剂。相比固体剂型，在此病例中选用的布洛芬口服混悬剂的优势在于
A. 小儿服用混悬剂更方便
B. 含量高，易于稀释，过量使用也不会造成严重的毒副作用
C. 混悬剂因颗粒分布均匀，对胃肠道刺激小
D. 适宜于分剂量给药
E. 含有山梨醇，味甜，顺应性高

正确答案：A、C、D、E。小儿服用混悬剂更方便；混悬剂因颗粒分布均匀，对胃肠道刺激小；适宜于分剂量给药；含有山梨醇，味甜，顺应性高

解析：本题考查混悬剂的优点。混悬剂有助于难溶性药物制成液体制剂，并提高药物的稳定性。混悬剂中的药物以固体微粒的形式存在，可以提高药物的稳定性。相比于固体制剂更加便于服用（A对）。混悬液属于粗分散体，可以掩盖药物的不良气味。产生长效作用，混悬剂中的难溶性药物的溶解度低，从而导致药物的溶出速度低，达到长效作用。布洛芬口服易吸收，但受饮食影响较大，而混悬剂因颗粒分布均匀，受食物影响小，对胃肠刺激小（C对），尤其易于分剂量给药（D对），含有山梨醇，味甜，患者顺应性高顺应性（E对）。过量使用可能会使血药浓度过高，产生严重的不良反应，造成严重的毒副作用（B错）。